胃癌病位在胃，与下列关系密切的是
A. 肝脾肾
B. 肝心肾
C. 脾肺肾
D. 心肺肾
E. 心脾肾

正确答案：A。肝脾肾

解析：胃癌发病发病一般较缓，病位在胃，与肝、脾、肾等脏关系密切（A对）。初期为痰瘀互结，以标实为主，久则病邪伤正，出现本虚标实。本虚以胃阴亏虚、脾胃虚寒和脾肾阳虚为主，标实为痰瘀互结。